对某氟牙症患者进行Dean氟牙症分类，其牙列中受损害最重的3颗牙描述如下：有1颗牙釉质有明显磨损，另2颗牙釉质白色不透明区占牙面40%，棕染。该患者的Dean分类为
A. 0.5
B. 1
C. 2
D. 3
E. 4

正确答案：C。2

解析：本题考查Dean氟牙症的分类标准。据题干该患者的Dean分类为2（C对）。Dean氟牙症的分类：0.5（A错）为牙釉质见轻度改变，不能诊断为轻型，但又不完全正常。1（B错）为牙釉质的不透明区域不超过牙齿唇面的25%。2为牙釉质的不透明区域不超过唇面的50%。3（D错）为牙齿的釉质表面明显磨损、棕染。4（E错）为牙釉质严重磨损，见明显的釉质发育不全表现，严重者可直接影响牙齿的正常形态。